如要进行某种药物对肿瘤疗效的分析，应选用
A. 现时寿命表
B. 完全寿命表
C. 简略寿命表
D. 定群寿命表

正确答案：D。定群寿命表

解析：本题考查定群寿命表。定群寿命表研究某同时出生人群的生命过程，用随访法进行，记录某特定人群中的每一个人从进入该特定人群到最后死亡的实际过程。如要进行某种药物对肿瘤疗效的分析，应选用定群寿命表（D对ABC错）。